属于评分加权征询法的环境质量指数是
A. Brown水质指数
B. I₁大气质量指数
C. 污染超标指数
D. AQI指数
E. 水质综合污染指数

正确答案：A。Brown水质指数

解析：本题考查属于评分加权征询法的环境质量指数。Brown水质指数（A对BCDE错）是由美国学者R.M.Brown建立的，属于评分加权征询法的环境质量指数。